在牙酸蚀症发病中占重要地位的因素是
A. 胃内容物反流
B. 饮食
C. 职业
D. 环境
E. 以上均是

正确答案：B。饮食

解析：本题考查酸蚀症。在牙酸蚀症发病中占重要地位的因素是饮食（B对）。1.内源性酸：体内的酸进入口腔，最常见的原因是由于患有某些疾病使胃内容物进入口腔（A错），胃酸长时间定期作用于牙齿硬组织使其患牙酸蚀症。常见疾病包括：①胃食管返流性疾病：如食管裂孔疝、消化道溃疡、胃食管反流征等消化道疾病引起的持续性返酸、慢性呕吐等症状；②受神经、心理影响的胃肠紊乱：如神经性呕吐、神经性厌食症、神经性贪食症等；③其他：如体内代谢及内分泌紊乱、妊娠期呕吐等。2.外源性酸包括：①饮食因素：饮食因素在牙酸蚀症的发病中占重要地位。②药物因素：一些pH较低的药物也可以引起牙酸蚀症。③环境因素（D错）：长期暴露于酸性气体或液体工作环境中的人易患牙酸蚀症，如电池厂或硫酸厂的工人、专业游泳运动员、品酒师等，其患病率及严重程度与接触酸的时间、是否采取保护措施有关。④职业（C错）：研究发现，制酸、汽车电池、电镀材料、化肥、酿酒行业有关人员是牙酸蚀症的高危人群，表明该病是典型的职业病。但随着劳动保护法的贯彻实施，这类患者已明显减少。